《中国药典》一部规定，槲寄生含量测定的化学成分是
A. 槲皮素
B. β-树脂醇
C. 黄槲寄生苷A
D. 橙皮苷
E. 齐墩果酸

正确答案：E。齐墩果酸